下列各项中哪项是错误的
A. 固连牙可表现为低于牙合面1～3mm
B. 恒牙未在正常位置萌出称为异位萌出
C. 乳牙比平均萌出时间晚1年以上萌出称为迟萌
D. 诞生牙是多生牙
E. 恒牙萌出时牙根未完全发育完成

正确答案：D。诞生牙是多生牙

解析：本题考查牙齿发育异常。诞生牙（D错，为本题的正确答案）是指婴儿出生时口腔内已萌出的牙齿，牙的数目并未发生变化，只是萌出时间过早，并不是多生牙，多生牙是指口腔内牙的数目多于正常的牙数，多生牙有明显的好发牙位，最常见的是上颌“正中多生牙”，其次，是上颌第四磨牙。固连牙（牙齿固连）是牙骨质与牙槽骨的直接结合，固连部位牙周膜丧失，表现为患牙低于（牙合）面1～3mm（A对）。恒牙未在正常位置萌出称为异位萌出（B对）。乳牙的正常萌出时间为6个月到2.5岁，如果超过1周岁后仍未见第一颗乳牙萌出，超过3周岁乳牙尚未完全萌出为乳牙迟萌，即乳牙比平均萌出时间晚1年以上萌出称为迟萌（C对）。恒牙萌出时牙根未完全发育完成（E对），此时为年轻恒牙阶段。